可以抑制骨髓造血功能的药品是
A. 甲硝唑
B. 甲氨蝶呤
C. 阿奇霉素
D. 曲克芦丁
E. 辛伐他汀

正确答案：B。甲氨蝶呤

解析：本题考查甲氨蝶呤。可以抑制骨髓造血功能的药品是甲氨蝶呤（B对）。甲氨蝶呤的主要不良反应是骨髓抑制，表现为白细胞、血小板减少；胃肠道上皮毒性，表现为口炎、胃炎、腹泻和便血。甲硝唑（A错）的不良反应较轻，可见恶心、呕吐、食欲减退、腹痛、腹泻，偶有荨麻疹、瘙痒、肢体麻木及感觉异常、中枢神经中毒症状，如头痛神经衰弱运动失调等。阿奇霉素（C错）的不良反应中消化道反应占大多数，主要症状包括腹泻（稀便）、上腹部不适（疼痛或痉挛）、恶心、呕吐，偶见腹胀，一般为轻至中度，偶见肝氨基转移酶可逆性升高。曲克芦丁（D错）的不良反应偶见胃肠道反应，表现为恶心及便秘。辛伐他汀（E错）的不良反应有腹痛、便秘、胃肠胀气、疲乏、无力、头痛等。